突发事件的潜伏期的工作内容不包括
A. 制定预案
B. 建立健全各种突发事件的预防策略和措施
C. 建立与维护预警系统和紧急处理系统
D. 训练救援人员
E. 总结报告

正确答案：E。总结报告

解析：本题考查突发事件的潜伏期的工作内容。潜伏期是突发公共卫生事件发生前的前兆期或酝酿期。事件还没有暴发，实际上是有一些蛛丝马迹表明事件要发生。这是突发公共卫生事件的预防与应急准备的关键时期，此期应积极制定预案（A对），建立健全各种突发公共卫生事件的预防策略和措施（B对），防止可避免的事件发生；建立与维护预警系统和紧急处理系统（C对），训练救援人员（D对），为应对突发公共卫生事件做好充分的准备。总结报告（E错，为本题正确答案）不属于突发事件的潜伏期的工作内容。